下列哪种细胞因子可以刺激T细胞分化
A. IL–12
B. IL–2
C. IL–3
D. IL–4
E. IL–6

正确答案：A。IL–12

解析：树突状细胞产生的IL-12可以刺激临近的T细胞分化，表现为旁分泌作用。掌握“细胞因子及受体”知识点。